从事驾车、高空作业的患者不宜服用的药物是
A. 对乙酰氨基酚
B. 氯苯那敏
C. 伪麻黄碱
D. 布洛芬
E. 氨溴索

正确答案：B。氯苯那敏

解析：本题考查驾驶员用药。氯苯那敏（B对）服用后可引起嗜睡和反应能力降低而影响驾驶员安全。对乙酰氨基酚（A错）不良反应为肝损伤。伪麻黄碱（C错）禁用于对伴有心脏病、高血压、甲状腺功能亢进症、青光眼、肺气肿及前列腺增生症患者。布洛芬（D错）妊娠及哺乳期妇女不宜用。氨溴索（E错）不良反应为轻微的上部胃肠道副作用。